白蛋白基因在肝脏表达而在肌肉不表达，这种基因表达的特点属于
A. 时间特异性
B. 空间特异性
C. 组织特异性
D. 细胞随机性
E. 时间随机性

正确答案：C。组织特异性

解析：基因表达具有时间特异性和空间特异性：①时间特异性是指基因表达按一定的顺序发生（A错）；②空间特异性（B对）是指多细胞生物个体在特定生长发育阶段，同一基因在不同的组织器官表达不同，空间特异性又称细胞特异性（D错）或组织特异性。白蛋白基因在肝脏表达而在肌肉不表达，因肝脏和肌肉是不同的组织，因此这种基因表达的特点属于组织特异性（C对）。